地西泮抗焦虑的作用部位是
A. 纹状体
B. 边缘系统
C. 脑皮层
D. 下丘脑
E. 中脑网状结构

正确答案：B。边缘系统

解析：本题考查地西泮抗焦虑的作用部位。一般理论认为BZ抗焦虑作用部位主要是在边缘系统（B对），低剂量地西泮即可抑制边缘系统中海马和杏仁核神经元电活动的发放和传递。镇静催眠作用则是与脑干核团内受体作用的结果。抗惊厥、抗癫痛作用与促进中枢抑制性递质GABA的功能有关。